影响矿物质吸收利用的物质是
A. 磷酸
B. 蛋白质
C. 直链淀粉
D. 果糖
E. 植酸

正确答案：E。植酸